对伤寒诊断及预后有指导意义的检查是
A. 血白细胞总数
B. 肥大反应
C. 嗜酸粒细胞计数
D. 血小板计数
E. 肝功能

正确答案：C。嗜酸粒细胞计数

解析：嗜酸性粒细胞计数（C对）对诊断和评估病情均有意义，伤寒患者的嗜酸性粒细胞减少或消失，病情好转时嗜酸性粒细胞逐渐恢复正常，若高于5%可排除伤寒。血小板计数（D错）及肝功能（E错）对伤寒的诊断及预后均无意义。白细胞总数（A错）对伤寒的诊断及预后仅有参考价值。肥大反应（B错）对伤寒的诊断有意义，对预后无意义。